部分激动剂的特点为
A. 与受体亲和力高而无内在活性
B. 与受体亲和力高而有内在活性
C. 具有一定亲和力，但内在活性弱，增加剂量后内在活性增强
D. 具有一定亲和力，内在活性弱，低剂量单用时产生激动效应，高剂量时可拮抗激动剂的作用
E. 无亲和力也无内在活性

正确答案：D。具有一定亲和力，内在活性弱，低剂量单用时产生激动效应，高剂量时可拮抗激动剂的作用

解析：本题考查作用于受体药物的分类。部分激动剂的特点为具有一定亲和力，内在活性弱，低剂量单用时产生激动效应，高剂量时可拮抗激动剂的作用（D对）。部分激动药具有较强亲和力，但内在活性低（α＜1），与受体结合后只能产生较弱的效应。即使浓度增加，也不能达到完全激动剂的最大效应；与激动剂合用，可因占据受体而能拮抗激动剂的部分效应。与受体亲和力高而无内在活性（A错）的是拮抗药。与受体亲和力高而有内在活性（B错）的是激动药。具有一定亲和力，但内在活性弱，增加剂量后内在活性增强（C错）的是完全激动药。无亲和力也无内在活性（E错）的是非特异性药物。